下列哪种不是黏附分子的功能
A. 促使中性粒细胞达到炎症部位
B. 免疫识别
C. 补体的活化
D. 炎症及凝血
E. 淋巴细胞归巢

正确答案：C。补体的活化